患者，女，25岁，已婚。月经周期先后不定，量多如注，持续十余日不净，婚后1年半，未避孕未孕。可诊断为
A. 月经先后无定期
B. 崩漏
C. 月经过多
D. 经期延长
E. 不孕症

正确答案：B。崩漏

解析：患者月经周期先后不定，量多入住，持续十余日不净，属崩漏之月经周期严重失常，经血淋漓不尽（B对）。月经先后无定期是指月经周期时或提前时或延后7天以上，连续3个周期以上者（A错）。月经过多是指月经量较正常明显增多，而周期基本正常，患者周期先后不定（C错）。经期延长是指月经周期基本正常，行经时间超过7天以上，甚或淋漓半月方净者，患者持续十余日不尽（D错）。不孕症指凡婚后未避孕、有正常性生活、同居2年而未受孕者，患者婚后1年半，不够2年（E错）。